目前我国最常用的临床牙位记录方法是
A. 国际牙科联合会系统记录方法
B. 通用编号系统记录方法
C. Palmer记录系统
D. 部位记录法
E. 英文字母记录法

正确答案：D。部位记录法

解析：常用的临床牙位记录方法有四种，其中我国最常用的临床牙位记录方法为部位记录法。掌握“牙的组成、分类、功能及牙位记录”知识点。